牙齿温度测验的注意事项如下，除外
A. 先测患牙
B. 热测温度为高于60℃
C. 隔离唾液
D. 冷测用小冰棍
E. 置牙齿唇（颊）或舌（腭）面的中1/3处测试

正确答案：A。先测患牙

解析：本题考查牙髓活力测验。牙齿温度测验的注意事项如下，除外先测患牙（A错，为本题的正确答案）。温度测验时，应该先测正常对照牙，再测可疑牙。牙齿温度测验的原理是突然、明显的温度变化可以诱发牙髓一定程度的反应或疼痛。正常牙髓对于50～60℃的热水很少引起疼痛，故以高于60℃（B对）为热测温度。在测验患牙时为了对照和减轻患者的紧张和不安，应先测验对照牙。牙髓活力测验时若未充分隔湿（C对）或干燥被测牙，会致电流泄露至牙周组织，引起假阳性反应，故应隔湿唾液。临床上冷诊最常用的是小冰棍（D对），可靠性比较好，减少误差。牙齿唇（颊）或舌（腭）面的中1/3处测试（E对）釉质较薄接近牙髓，误差更小，故在牙齿温度测验时一般都是将小冰棍或者牙胶棒置于此处。